某女，72岁。左下肢静脉曲张病史20年，平素腰膝酸软。6天前左下肢静脉曲张处出现青紫色，呈条索状凸起，疼痛难忍，行走困难，由家属搀扶走入诊室。大便干结3天。医师检查：左下肢红肿，大小约5cm×15cm，体温38.9℃。舌红、苔黄、脉弦数。证属血热毒盛、脉络瘀阻。处以丹参、虎杖、大青叶、络石藤、金银花、川牛膝、防己、大血藤、生甘草。患者治疗半个月后，红肿热痛大减，可自主行走，但仍觉腰膝酸软。医师用首诊处方减金银花、大青叶，改川牛膝为牛膝。此因与川牛膝相比，牛膝具有的功效是
A. 补肝肾、强筋骨
B. 清热解毒
C. 引血下行
D. 利尿通淋
E. 消肿生肌

正确答案：A。补肝肾、强筋骨

解析：本题考查牛膝的功效。此因与川牛膝相比，牛膝具有的功效是补肝肾，强筋骨（A对）。牛膝【功效】活血通经，利尿通淋，引血下行，补肝肾，强筋骨。川牛膝【功效】逐瘀通经，通利关节，利尿通淋（D错），引血下行（C错）。金银花【功效】清热解毒（B错），疏散风热。白及【功效】收敛止血，消肿生肌（E错）。